属于化学灭菌法的是
A. 热压灭菌法
B. 流通蒸汽灭菌法
C. 火焰灭菌法
D. 微波灭菌法
E. 气体灭菌法

正确答案：E。气体灭菌法

解析：本题考查化学灭菌法。化学灭菌法指用化学药品直接作用于微生物而将其杀死的方法，可分为气体灭菌法（E对）和液体灭菌法。